避光保存的药品有
A. 硝普钠
B. 维生素C
C. 硝苯地平
D. 硝酸甘油
E. 对氨基水杨酸钠

正确答案：A、B、C、D、E。硝普钠；维生素C；硝苯地平；硝酸甘油；对氨基水杨酸钠

解析：本题考查药品的贮存。硝普钠（A对）、维生素C（B对）、硝苯地平（C对）、硝酸甘油（D对）、对氨基水杨酸钠（E对）等应避光保存。易受光线影响而变质的药品，需要遮光保存，应放在阴凉干燥、阳光不易直射到的地方。门、窗可悬挂遮光用的黑布帘、黑纸，以防阳光直射。可采用棕色瓶或黑色纸包裹的玻璃容器包装，以防止紫外线的透入。